胆汁酸类化合物母核属于
A. 甾体化合物
B. 萜类化合物
C. 蛋白质类化合物
D. 多糖类化合物
E. 有机酸类化合物

正确答案：A。甾体化合物

解析：本题考查的是胆汁酸的结构特点。胆汁酸类化合物母核属于甾体化合物（A对）。天然胆汁酸是胆烷酸的衍生物，在动物的胆汁中它们通常与甘氨酸或牛磺酸的氨基以酰胺键结合成甘氨胆汁酸或牛磺胆汁酸，并以钠盐形式存在。胆烷酸的结构中有甾体母核。胆汁酸的结构中多有羟基存在。萜类化合物（B错）是一类数量巨大、结构种类繁多、生物活性多样、具有很高药用价值的天然化学成分，在中药中分布极为广泛。如穿心莲、青蒿、龙胆、紫杉等众多中药的有效成分均为萜类化合物。蛋白质类化合物（C错）大量存在于中药中，但在中药制剂工艺中，大多数情况是将其视为杂质而除去。含蛋白质类的中药有水蛭等。多糖类化合物（D错）存在于许多中药中，一些中药中的多糖具有很强的生物活性。如香菇多糖、灵芝多糖、猪苓多糖等均具有抗肿瘤作用；昆布中的昆布素有治疗动脉粥样硬化作用；黄芪多糖和人参多糖具有免疫调节作用；银耳多糖能有效地保护肝细胞等。有机酸类化合物（E错）是一类含羧基的化合物（不包括氨基酸），广泛分布在植物界中，存在于植物的花、叶、茎、果、根等部位，多数与钾、钠、钙等金属离子或生物碱结合成盐的形式存在，也有结合成酯存在的。含有机酸的中药有金银花、当归、丹参、马兜铃等。